下列对于肝门的说法，正确的是
A. 出肝门的结构是门静脉
B. 入肝门的结构是肝管
C. 出第二肝门的结构是下腔静脉
D. 入第二肝门的结构是肝静脉
E. 无上述情况

正确答案：E。无上述情况

解析：出入肝门结构为同一结构，即肝左右管入肝门且出肝门，以此类推，出入肝门的结构为肝左右管，肝固有动脉左右支，肝门静脉左右支，神经和淋巴管(AB错)，出入第2肝门的结构为肝左中右静脉(CD错，故E为本题正确答案)即并无单进或单出肝门或第二肝门的情况。